某医师为评价某新药对流感的治疗效果，共收治100例流感患者，一周后治愈的有90例，由此认为该新药对流感疗效显著。针对此试验，正确的观点是
A. 结论不能肯定，因为未作统计学处理
B. 结论不能肯定，因为试验样本含量较少
C. 结论正确，因为治愈率达90%
D. 结论不能肯定，因为未作重复试验
E. 结论不能肯定，因为未设对照组

正确答案：E。结论不能肯定，因为未设对照组

解析：临床试验是以人(含病人与健康人）为试验对象，对干预措施的疗效和安全性进行前瞻性的研究，从研究的性质划分，属于实验性研究的范畴，因此临床试验设计也必须遵循实验设计的基本原理，其设计的基本要素也包括研究对象、处理因素和实验效应，同时必须遵循对照、随机化和重复的基本原则。但由于其研究对象为人，还应该考虑受试者的知情同意、心理因素、伦理道德等。其中随机化和对照（E对ABC错）是最基本的原则，而重复原则（B错）则是为提高准确度，并非最基本的原则。